分子结构中含多个羟基，比旋度为右旋的药物是
A. 维生素E
B. 维生素B₁
C. 维生素B₆
D. 维生素B₂
E. 维生素C

正确答案：E。维生素C